说明以下药物配伍使用的目的:吗啡与阿托品联合使用
A. 改变尿液pH，有利于药物代谢
B. 产生协同作用，增强药效
C. 减少或延缓耐药性的产生
D. 形成可溶性复合物，有利于吸收
E. 利用药物的拮抗作用，克服某些毒副作用

正确答案：E。利用药物的拮抗作用，克服某些毒副作用